急性骨膜下脓肿患者典型的局部症状是
A. 患牙Ⅲ度松动、叩痛（+++）
B. 根尖部龈红肿、扪龈红肿、扪痛
C. 区域淋巴结肿大压痛
D. 移行沟变浅，深部波动感
E. 相应面部软组织反应性水肿

正确答案：D。移行沟变浅，深部波动感

解析：本题考查急性骨膜下脓肿典型的局部症状。急性化脓性根尖周炎发展到骨膜下脓肿时脓液集聚于坚韧致密的骨膜下，使骨膜隆起，移行沟处软组织肿胀隆起，其典型症状是移行沟变浅，深部波动感（D对）。患牙Ⅲ度松动、叩痛（+++）（A错）、根尖部龈红肿、扪龈红肿、扪痛（B错）和区域淋巴结肿大压痛（C错）都是骨膜下脓肿的症状，但是根尖周脓肿时也有这些症状，它们并不是骨膜下脓肿典型的症状。相应面部软组织反应性水肿（E错）表现为软组织肿胀、压痛、面容改变等颌面部蜂窝织炎的症状，多见于严重骨膜下脓肿的病例中，并不是骨膜下脓肿的典型表现。